发育的不正确表述是
A. 细胞和组织的分化
B. 功能的不断完善
C. 心理智力的发展
D. 运动技能的获得
E. 个体在形态和功能方面已全面达到成人水平

正确答案：E。个体在形态和功能方面已全面达到成人水平

解析：本题考查发育的概念。在发育过程中，是个体从其生命开始到成熟的变化，是生物有机体的自我构建和自我组织的过程，还没有完全达到成人水平（E错，为本题正确答案）。发育是指细胞、组织、器官分化与功能成熟（ABD对），是机体质的变化，包括情感-心理（C对）的发育成熟过程。